孙思邈主张医家必须具备精，是指
A. 不断学习，提高医疗技术，有精湛的医术
B. 不断学习，对病人一心赴救
C. 不断学习，对病人一视同仁
D. 不断学习，有高尚医德
E. 不断学习，热爱救人

正确答案：A。不断学习，提高医疗技术，有精湛的医术

解析：我国唐代伟大医学家孙思邈在《千金要方》中的“大医精诚”篇章中，他主张大医必须“精”和“诚”。所谓“精”就是要求医家不断地学习、提高医疗技术，达到医术精湛（A对）；所谓“诚”就是强调医家应具有高尚的医学道德，并明确指出医家要有“大慈侧隐之心”，不得追，求名利，对病人应当“普同一等”、“一心赴救”、认真负责，不得浮夸自吹、低毁他人等。只有具备“精”和“诚”的医家才是“大医”，即高尚优秀的医家。